患者，男，39岁。近3日来，两胁胀痛，时有恶心呕吐，口苦，舌红苔黄腻。治疗除取期门、太冲、支沟穴外，还应取
A. 合谷、丘墟
B. 内庭、三阴交
C. 阳陵泉、足三里
D. 内关、行间
E. 足临泣、曲池

正确答案：C。阳陵泉、足三里

解析：患者胁痛，呈现出肝胆湿热之征象，应疏肝理气，通络止痛，主穴选用期门、支沟、阳陵泉、足三里（C对）。合谷在大肠经上，无治胁痛、呕吐之能（A错）。三阴交属于脾经，不能治肝胆湿热之胁痛（B错）。内关虽可止呕，但不可治胁痛（D错）。曲池属手阳明大肠经，不可治胁痛及呕吐（E错）。